患者，男，57岁，肾功能正常，既往有动脉粥样硬化，高血压合并2型糖尿病，服用下列药物后出现踝关节肿胀，到药房咨询，药师提示有可能引起不良反应的药物是
A. 赖诺普利片
B. 格列吡嗪肠溶片
C. 阿司匹林肠溶片
D. 硝苯地平缓释片
E. 阿托伐他汀片

正确答案：D。硝苯地平缓释片

解析：本题考查硝苯地平。引起该不良反应的药物是硝苯地平（D对）。硝苯地平属于钙通道阻滞剂（CCB），所致的主要不良反应有踝部关节水肿、头痛、心悸、眩晕、麻木、耳鸣、颜面潮红、发热等。其水肿的特点为晨轻午重，多见于踝关节、下肢、足部或小腿，少见于面部和其他部位。